临床上用于治男性缺乏雄激素病的甾体激素
A. 黄体酮
B. 甲睾酮
C. 雌二醇
D. 苯丙酸诺龙
E. 醋酸甲地孕酮

正确答案：B。甲睾酮

解析：本题考查甲睾酮。甲睾酮（B对）用于治疗男性缺乏雄激素病。黄体酮（A错）为天然孕激素，临床上用于习惯性流产、痛经、经血过多或血崩症、闭经等。雌二醇（C错）为天然雌激素，临床用于卵巢功能不全或卵巢激素不足引起的各种症状。苯丙酸诺龙（D错）为蛋白同化激素，主要用于蛋白质缺乏症。醋酸甲地孕酮（E错）为一高效黄体激素，用于治疗月经不调、功能性子宫出血、子宫内膜异位症；晚期乳腺癌和子宫内膜腺癌。